甘草中具有解毒、抗炎、抗癌、抑制艾滋病毒复制作用的化学成分是
A. 甘草次酸
B. 甘草苷
C. 甘草酚
D. 甘草甜素
E. 甘草香豆素

正确答案：D。甘草甜素

解析：本题考查的是甘草的药理作用。甘草中具有解毒、抗炎、抗癌、抑制艾滋病毒复制作用的化学成分是甘草甜素（D对）。甘草中黄酮类化合物中抗菌成分较多，对金黄色葡萄球菌、链球菌、枯草杆菌、酵母菌、真菌等均有抑制作用。甘草甜素对人体免疫性缺陷病毒、肝炎病毒、腺病毒Ⅲ型、Ⅰ型单纯疱疹病毒、牛痘病毒均有明显的抑制作用。甘草解毒作用的有效成分主要为甘草甜素。从胀果甘草中提取的黄酮类混合物可有效地预防巴豆油对小鼠皮肤的促癌作用。甘草甜素能增强CTX及VCR的抗癌活性，甘草甜素水解为甘草次酸单葡萄糖酸苷，对多种原因诱发的小鼠皮肤癌、肺癌有抑制作用。甘草流浸膏、甘草次酸（A错）、甘草黄酮均有镇咳、祛痰作用。甘草粉、甘草浸膏、甘草次酸、甘草素、甘草苷（B错）、异甘草苷对多种实验性溃疡模型均有抑制作用，能促进溃疡愈合。